通过网络传播口腔健康信息，强化公众已有的口腔卫生知识，干预不健康的行为，此属于口腔健康教育途径中的
A. 个别交谈
B. 学校授课
C. 大众传媒
D. 小型讨论会
E. 社区活动

正确答案：C。大众传媒

解析：大众传媒：通过网络、报刊、杂志、电视、电影、广播、街头展板与宣传橱窗等传播口腔健康信息，反复强化公众已有的口腔卫生知识，干预不健康的行为如爱吃零食、不刷牙等不健康行为。掌握“口腔健康教育”知识点。